关于特异性投射系统叙述，错误的是
A. 能够激发大脑皮质发出冲动
B. 所有的传入冲动都经过丘脑换元
C. 有点对点的投射关系
D. 引起特定感觉
E. 投射到大脑皮质特定区域

正确答案：B。所有的传入冲动都经过丘脑换元